下列关于磨耗的相关叙述中，不恰当的说法是
A. 它是一种渐进性消耗的生理现象
B. 牙齿的磨耗随年龄的增长而逐渐明显
C. 多发生在牙齿的（牙合）面、切嵴及邻面
D. 刷牙引起的前后牙唇、颊面的非生理性损耗属于磨耗
E. 嗑瓜子造成的上下中切牙切缘的楔形缺损不属于磨耗

正确答案：D。刷牙引起的前后牙唇、颊面的非生理性损耗属于磨耗

解析：本题考查牙动度和唇、舌、腭对咀嚼的作用。磨损：—般指牙齿表面与外物机械性摩擦而产生的牙体组织损耗。如刷牙引起的前后牙唇、颊面的非生理性损耗（D错，为本题正确答案）；嗑瓜子造成的上下中切牙切缘的楔形缺损。